患者，男，56岁。患慢性支气管炎10余年，近日来咳嗽加重，咽痒，咯稀薄白色痰，舌苔薄白，脉浮。治疗应首选
A. 青霉素加麻杏石甘汤
B. 青霉素加参苏饮
C. 麦迪霉素加泻白散
D. 复方新诺明加二陈汤
E. 庆大霉素加清金化痰汤

正确答案：B。青霉素加参苏饮

解析：患者有慢性支气管炎病史，由于卫气不固，外感风寒，气虚托送无力，邪不易解，故咳嗽加重，咽痒，咯稀薄白色痰；舌苔薄白，脉浮，为气虚外感证，治疗应益气解表，理气化痰，代表方选用参苏饮加减。急性期应用青霉素类广谱抗生素抗炎（B对）。青霉素加麻杏石甘汤（A错）治疗外感风寒，内有痰热证。麦迪霉素加泻白散（C错）治疗肺内郁热证。复方新诺明加二陈汤（D错）用于治疗痰湿阻肺证。庆大霉素加清金化痰汤（E错）治疗痰热蕴肺证。